在病例对照研究的资料分析中，描述性分析不包括
A. 病例和对照的均衡性检验
B. 病例和对照某研究因素暴露率的比较
C. 病例和对照的年龄、性别构成比较
D. 病例和对照的例数描述
E. 病例和对照的可比性分析

正确答案：B。病例和对照某研究因素暴露率的比较

解析：本题考查病例对照研究的资料分析。在病例对照研究的资料分析中，描述性分析包括：病例和对照的均衡性检验（A对）；病例和对照的年龄、性别构成比较（C对）；病例和对照的例数描述（D对）；病例和对照的可比性分析（E对）等。病例和对照某研究因素暴露率的比较（B错，为本题正确答案）属于推断性分析。